醋酸氢化可的松是药品的
A. 商品名
B. 化学名
C. 通用名
D. 俗名
E. 品牌名

正确答案：C。通用名

解析：本题考查药物的名称。醋酸氢化可的松是药品的通用名（C对）。药物的名称包括药物的通用名，化学名和商品名。药品通用名也称为国际非专利药品名称（INN），通常是指有活性的药物物质，而不是最终的药品，因此是药学研究人员和医务人员使用的共同名称。药品的商品名（A错），又称为品牌名（E错），通常是针对药物的最终产品，即剂量和剂型已确定的含有一种或多种药物活性成分的药物。药物的化学名（B错）是根据药品的化学成分确定的化学学术名称。有些药物的名称因常被应用，可称之为该药的别名或俗名（D错），如氟哌酸是诺氟沙星的俗名，先锋4号是头孢氨苄的俗名等。